具有控释和缓释作用的硝苯地平制剂的商品名包括
A. 心痛定
B. 拜心通
C. 得高宁
D. 利心平
E. 硝苯啶

正确答案：A、B、D。心痛定；拜心通；利心平